“化妆品生产企业卫生许可证”制度是
A. 保证化妆品卫生安全的手段
B. 保护高危人群安全的手段
C. 防止化妆品不良反应的手段
D. 针对生产工人健康的监督手段
E. 对销售企业的监督手段

正确答案：A。保证化妆品卫生安全的手段

解析：本题考查“化妆品生产企业卫生许可证”制度。“化妆品生产企业卫生许可证”制度是保证化妆品卫生安全的手段（A对BCDE错）。